咳出由血液和粘液混合的砖红色胶冻状痰为特征的疾病是
A. 克雷伯杆菌肺炎
B. 肺炎球菌肺炎
C. 葡萄球菌肺炎
D. 支原体肺炎
E. 念珠菌肺炎

正确答案：A。克雷伯杆菌肺炎

解析：砖红色胶冻状痰常见于克雷伯杆菌肺炎（A对）。肺炎球菌肺炎（B错）常咳铁锈色痰。葡萄球菌肺炎（C错）常咳脓血痰。支原体肺炎（D错）咳少量粘液痰。念珠菌肺炎（E错）咳泡沫塑料样痰。